通过调节体内激素平衡，用于治疗前列腺癌的药物是
A. 他莫昔芬
B. 曲妥珠单抗
C. 戈舍瑞林
D. 贝伐珠单抗
E. 阿达木单抗

正确答案：C。戈舍瑞林

解析：本题考查前列腺癌治疗药物。戈舍瑞林（C对）主要用于可用激素治疗的前列腺癌，可用激素治疗的绝经前期及围绝经期妇女的乳腺癌以及缓解子宫内膜异位症症状包括减轻疼痛并减少子宫内膜损伤的大小和数目。